下列哪一项不会引起病理性根吸收
A. 乳牙牙髓炎
B. 乳牙根尖周炎症
C. 牙外伤
D. 活髓切断术
E. 牙萌出

正确答案：E。牙萌出

解析：本题考查病理性根吸收。牙萌出（E错，为本题的正确答案）不会引起病理性根吸收。乳牙在替换期的吸收属生理性吸收，有利于完成乳、恒牙顺利替换的生理过程。牙外伤（C对）是指牙受到各种机械外力作用所发生的牙周组织、牙髓组织和牙体硬组织的急剧损伤，会引起牙根病理性吸收。甲醛甲酚切断术或戊二醛切断术（D对）尽管可保持根尖部的牙髓活力，但是由于手术创伤、甲醛甲酚刺激、边缘性泄露、剩余根髓感染和炎性变等因素的影响，术后可能引起牙根病理性吸收。乳牙牙髓炎或尖周炎（AB对）的炎症波及根尖部引起牙根病理性吸收，可导致牙齿过早脱落。